某学生参加小学入学体检，远视力左眼0.5，右眼1.0。到眼科医院就诊，医生对他进行屈光矫正后，远视力为0.7。按照程度，所患眼病属于
A. 轻度
B. 中度
C. 重度
D. 极重度
E. 超重度

正确答案：A。轻度